关于保健食品的说法，错误的是
A. 适用于特定人群，具有调节机体功能作用
B. 声称保健功能的，应当具有科学依据
C. 不得对人体产生急性、亚急性或者慢性危害
D. 可以声称对疾病有一定程度的预防治疗作用

正确答案：D。可以声称对疾病有一定程度的预防治疗作用

解析：本题考查保健食品的界定。保健食品不以治疗疾病为目的（D错，为本题正确答案）。保健食品，是指声称具有特定保健功能或者以补充维生素、矿物质为目的的食品。即适宜于特定人群食用，具有调节机体功能（A对），不以治疗疾病为目的，并且对人体不产生任何急性、亚急性或者慢性危害的食品。保健食品声称保健功能，应当具有科学依据（B对），不得对人体产生急性、亚急性或者慢性危害（C对）。